患者女性，60岁舌左侧缘中部溃烂5个月，约2.3cm×1.5cm×0.5cm大小，活检报告为“鳞癌”，左下6残根，边缘锐利。舌癌的好发部位
A. 舌尖
B. 舌缘
C. 舌根
D. 舌背
E. 以上都不是

正确答案：B。舌缘

解析：本题考查舌癌的好发部位。患者女性，60岁舌左侧缘中部溃烂5个月，约2.3cm×1.5cm×0.5cm大小，活检报告为“鳞癌”，左下6残根，边缘锐利，综合考虑为舌癌，舌癌的好发部位是舌缘（B对），其次为舌尖（A错）、舌背（D错）。舌癌是最常见的口腔癌，男性多于女性，但是近年来有女性增多及发病率更年轻化的趋势，舌癌一般恶性程度较高，生长快，浸润性较强，常波及舌肌，致舌运动受限。有时说话、进食及吞咽内发生困难。晚期舌癌可蔓延至口底肌肉及下颌骨，使全舌固定；向后发展可以侵犯腭舌弓及扁桃体。如有继发感染或侵犯舌根常发生剧烈疼痛，疼痛可反射至耳颞部及整个同侧的头面部。舌根（C错）好发口咽癌。